桥体龈面最好采用的材料是
A. 陶瓷
B. 中熔合金
C. 高熔合金
D. 热凝塑料
E. 自凝塑料

正确答案：A。陶瓷

解析：桥体龈面最好采用的材料是陶瓷（A对）。陶瓷桥体龈面硬度大，韧性高，化学性质稳定，生物相容性好，美观，舒适，桥体龈面最好采用的材料是陶瓷。中熔合金（B错）铸造性能较好，但是化学稳定性较低，在口腔内可产生不同程度的腐蚀变色现象。高熔合金（C错）不美观，只能用于比较隐蔽的后牙固定桥。热凝塑料（D错）、自凝塑料（E错）等塑料材料硬度低、易磨损，化学性质不稳定，易变色，易老化，一般只用作暂时性固定桥。